检查某药物中的重金属，称取样品1.0g，依法检查，与标准铅溶液（10/㎍Pb/ml）1.0ml色相同条件下制成的对照溶液比较，不得更深。重金属的限量为
A. 百万分之一
B. 百万分之十
C. 百万分之二十
D. 0.0001
E. 0.001

正确答案：D。0.0001